阿米卡星属于
A. 大环内酯类抗生素
B. 四环素类抗生素
C. 氨基糖苷类抗生素
D. 氯霉素类抗生素
E. β-内酰胺类抗生素

正确答案：C。氨基糖苷类抗生素

解析：本题考查阿米卡星。阿米卡星是由氨基糖与氨基醇形成的苷，为氨基糖苷类抗生素（C对）；大环内酯类抗生素（A错）有红霉素；四环素类抗生素（B错）有金霉素、四环素等；氯霉素类抗生素（D错）有氯霉素；β-内酰胺类抗生素（E错）分为青霉素类和头孢菌素类。